女性，22岁，因右下智齿低位埋伏阻生，要求拔除，下面哪项不正确
A. 术前应摄牙片
B. 应进行阻力分析
C. 应翻舌侧瓣
D. 不应以邻牙为支点
E. 术后应清理拔牙创

正确答案：C。应翻舌侧瓣

解析：本题考查下颌阻生第三磨牙拔除。下颌第三磨牙舌侧骨板薄，拔牙时易骨折，舌神经从舌侧穿过，故不宜翻舌侧瓣（C错，为本题的正确答案），以免引起舌侧骨板折裂或损伤舌神经。下颌第三磨牙拔出前应拍摄X线片（A对），掌握其在颌骨中的位置、方向以及与邻牙、下颌管的关系等等。下颌第三磨牙的阻生状况具有多样性，将其拔出的关键是如何解除牙周围的各种阻力，因此手术前对阻力进行分析（B对），可以避免手术的盲目性，减少手术创伤，缩短手术时间。拔除下颌智齿时不应以邻牙为支点（D对），以免损伤邻牙，应以牙槽间隔为支点。拔出阻生下颌智齿常需要使用劈开法或去骨法，会产生碎片或者碎屑，术后应仔细清理拔牙创（E对），以免拔牙创内遗留异物继发感染。